腺淋巴瘤又称Warthin瘤，淋巴乳头状囊腺瘤。多数发生于
A. 腮腺和腮腺的淋巴结
B. 下颌下腺
C. 舌下腺
D. 腭部小涎腺
E. 唇腺

正确答案：A。腮腺和腮腺的淋巴结

解析：腺淋巴瘤又称为Warthin瘤、淋巴乳头状囊腺瘤，绝大多数发生于腮腺和腮腺的淋巴结，多数位于腮腺下极。掌握“沃辛瘤及嗜酸性腺瘤”知识点。